女，24岁。咽痛2周后出现肉眼血尿，尿RBC满视野，尿蛋白定量0.9g/d，肾功能及血压正常，ANA（-）。其最可能诊断是：
A. 急进性肾小球肾炎
B. 隐匿性肾小球肾炎
C. 慢性肾小球肾炎
D. 急性肾小球肾炎
E. IgA肾病

正确答案：D。急性肾小球肾炎

解析：患者为青年女性，前期有咽痛病史（提示呼吸道感染病史），之后出现肉眼血尿，尿RBC满视野，尿蛋白定量0.9g/d，肾功能及血压正常（排除急进性肾小球肾炎），ANA（-）（排除狼疮肾炎），患者上呼吸道感染两周后出现血尿及蛋白尿，可诊断为急性肾小球肾炎（D对），大多数病例与感染有关，又称感染后肾炎，一般是由链球菌感染后引起的变态反应性疾病。急进性肾小球肾炎（A错）肾功能急剧恶化、多在早期出现少尿性急性肾衰竭为临床特征，患者肾功能无异常，可排除该诊断（P467）。隐匿性肾小球肾炎（B错）仅表现为肾小球源性血尿或（和）蛋白尿的一组肾小球疾病，多无前驱感染史（P477），故不考虑该诊断。慢性肾小球肾炎（C错）需病程长达3月以上才可确诊（P478），患者病程短，不能诊断为该病。IgA肾病（E错）常在上呼吸道感染后（24～72小时，偶可更短）后突发肉眼血尿，持续数小时至数日，可转为镜下血尿，少数患者肉眼血尿可反复发作，该患者上感后2周才发病，可排除IgA肾病（P469）。